氯丙嗪神经安定作用的机制是
A. 阻断呕吐中枢
B. 阻断结节－漏斗通路
C. 阻断胃黏膜传入纤维
D. 阻断黑质－纹状体通路
E. 阻断中脑-边缘系统和中脑-皮层系统的D2样受体

正确答案：E。阻断中脑-边缘系统和中脑-皮层系统的D2样受体

解析：氯丙嗪通过阻断中脑-边缘系统和中脑-皮层系统的D2样受体，对中枢神经系统有较强的抑制作用，也称神经安定作用。氯丙嗪能显著控制活动状态和躁狂状态而又不损伤感觉能力。掌握“氯丙嗪”知识点。